最常见的女性生殖器结核为
A. 卵巢结核
B. 宫颈结核
C. 输卵管结核
D. 子宫内膜结核
E. 阴道结核

正确答案：C。输卵管结核

解析：最常见的女性生殖器官结核是输卵管结核（C对），占90%～100%，是由于输卵管黏膜有利于结核菌的潜伏感染；子宫内膜结核（D错）常由输卵管结核蔓延而来，占50%～80%；卵巢结核（A错）占20%～30%；宫颈结核（B错）常由子宫内膜结核蔓延而来或经淋巴或血液循环传播，较少见，占10%～20%；阴道结核（E错）也较少见。